细菌蛋白质合成的场所是
A. 核质
B. 质粒
C. 核糖体
D. 肽聚糖
E. 胞质颗粒

正确答案：C。核糖体

解析：核糖体：每个细菌可含有万余个核糖体，它由占66%的RNA及占34%的蛋白质构成，是细菌蛋白质合成的场所。掌握“细菌的大小、形态和基本结构”知识点。